患者，女，60岁。素有高血压病史，猝然昏厥，不省人事，两手握紧，牙关紧闭，右侧肢体偏瘫用药应首选的药物是
A. 冰片
B. 麝香
C. 石菖蒲
D. 郁金
E. 苏合香

正确答案：B。麝香

解析：麝香性味辛温，归心脾二经，其功效为开窍醒神，活血通经，消肿止痛；可治疗热病神昏，中风痰厥，气郁暴厥，中恶昏迷（B对）。冰片味辛气香，有开窍醒神之功效，功似麝香但力较弱，二者常相须为用。因其性偏寒凉，为凉开之品，宜用于热病神昏（A错）。石菖蒲擅治痰湿秽浊之邪蒙蔽清窍所致之神志昏乱（C错）。郁金治湿温病浊邪蒙蔽清窍，胸脘痞闷，神志不清；治痰浊蒙蔽心窍之癫痫发狂（D错）。苏合香有开窍醒神之效，作用与麝香相似而力稍逊，且长于温通、辟秽，故为治面青、身凉、苔白、脉迟之寒闭神昏的要药（E错）。